以下哪种药物或材料不能作为盖髓剂
A. 防腐剂
B. 抗生素
C. 牙髓失活剂
D. 骨形成蛋白
E. 无机三氧化物聚合物

正确答案：C。牙髓失活剂

解析：许多药物和材料可作为盖髓剂用于盖髓治疗，包括防腐剂、抗炎剂、抗生素、酶类、无机三氧化物聚合物（MTA）以及骨形成蛋白、脱矿牙本质等生物材料，其中氢氧化钙和MTA在临床使用最广。掌握“盖髓术”知识点。